固定义齿基牙牙槽骨吸收不能超过根长的
A. 1/3
B. 1/2
C. 1/4
D. 2/3
E. 3/4

正确答案：A。1/3

解析：本题考查局部固定义齿修复的基牙条件。固定义齿修复最为理想的情况是牙周无进行性炎症，根尖周无病变，牙槽骨及颌骨结构正常牙槽骨无吸收。但是在临床上很难遇到理想的状况，较为常见的是牙周无不可治愈的炎症，无病理性动度，牙槽骨吸收最多不超过根长的1/3（A对），个别特殊病例条件放宽，吸收不可以超过根长的1/2。